下列哪种不是黏附分子的功能
A. 细胞活化增生
B. 肿瘤转移
C. 补体活化
D. 炎症及凝血
E. 淋巴细胞归巢

正确答案：C。补体活化